下述哪个结构不是蝶骨上的结构
A. 翼管
B. 颞下嵴
C. 眶上裂
D. 棘孔
E. 三叉神经压迹

正确答案：E。三叉神经压迹

解析：三叉神经压迹是颞骨上的结构（E错，为本题正确答案）。翼管（A对）、颞下嵴（B对）、眶上裂（C对）、棘孔（D对）均是蝶骨上的结构。